临床试验的效果评价指标不包括
A. 有效率
B. 治愈率
C. 生存率
D. 保护率
E. 好转率

正确答案：D。保护率